木香性温，能通理三焦，其主治病证是
A. 肝瘀血瘀之脘痛
B. 肝火郁滞之协痛
C. 痰浊闭阻之胸痹
D. 痰湿壅肺之咳喘
E. 脾胃气滞之脘腹胀痛

正确答案：E。脾胃气滞之脘腹胀痛

解析：本题考查的是木香的主治病证。木香性温，能通理三焦，其主治病证是脾胃气滞之脘腹胀痛（E对）。木香：【主治病证】（1）脾胃气滞之脘腹胀痛。（2）下痢腹痛、里急后重。（3）脾运失常、肝失疏泄之胁肋胀痛、泄泻。（4）脾虚气滞之食少吐泻。玫瑰花：【主治病证】（1）肝胃气滞之胸胁脘腹胀痛。（2）肝郁血瘀（A错）之月经不调、乳房胀痛。（3）外伤肿痛。薤白：【主治病证】（1）痰浊闭阻胸阳之胸痹证（C错）。（2）胃肠气滞，泻痢里急后重。陈皮：【主治病证】（1）脾胃气滞之脘腹胀满或疼痛、嗳气、恶心呕吐。（2）湿浊中阻之胸闷腹胀、纳呆便溏。（3）痰湿壅肺之咳嗽气喘（D错）。主治病证为肝火郁滞之胁痛（B错）的中药，2022年考试指南未明确说明。